属于盆底内肌（即盆膈）肌肉的是
A. 球海绵体肌
B. 会阴深横肌
C. 肛提肌
D. 坐骨海绵体肌
E. 肛门外括约肌

正确答案：C。肛提肌

解析：属于盆底内层(即盆膈)肌肉的是肛提肌（C对）。球海绵体肌（A错）、坐骨海绵体肌（D错）、肛门外括约肌（E错）属于盆底外层肌肉。会阴深横肌属于盆底中层肌肉（B错）。